菱形窝
A. 位于脑桥和中脑背面
B. 位于延髓和脑桥腹面
C. 上部两边界为小脑下脚
D. 下部两边界为小脑上脚
E. 窝底正中沟与界沟之间称内侧隆起

正确答案：E。窝底正中沟与界沟之间称内侧隆起

解析：菱形窝位于延髓上部和脑桥的背侧面（AB错），.窝底正中沟与界沟之间称内侧隆起（E对），其外上界小脑上角（C错），外下界界自内下向外上依次为薄束结节、楔束结节和小脑下脚（D错）。